隔姜灸的作用是
A. 清热解毒的杀虫
B. 温肾壮阳
C. 温中散寒，扶阳固脱
D. 防病保健
E. 解表散寒温中

正确答案：E。解表散寒温中

解析：该题考查灸法的作用。隔姜灸常用于因寒而致的呕吐、腹痛以及风寒痹痛等，有解表散寒温中的作用（E对）。隔蒜灸有清热解毒、杀虫的作用（A错）。隔附子饼灸具有温补肾阳的作用（B错）。灸法（P152）具有温经散寒，扶阳固脱，消瘀散结，防病保健的作用（CD错）。